用钼靶X线摄片检查方法做乳腺癌的筛检试验，分别检查了100名经活检确诊为乳腺癌的妇女和100名未患乳腺癌的妇女，结果如下：乳腺癌妇女筛查结果阳性64例，阴性36例；非乳腺癌妇女筛查结果阳性16例，阴性84例。此项筛检试验中灵敏度为
A. 16%
B. 84%
C. 64%
D. 36%
E. 74%

正确答案：C。64%

解析：灵敏度指金标准确诊的病例中待评价试验也判断为阳性者所占的百分比，灵敏度=a/（a+c）×100%，其中a代表真阳性，c代表假阴性。根据题目描述，可知a为64，c为36，灵敏度=64/（64+36）×100%=64%（C对）。